氟斑牙的结构造就了以下哪种特点
A. 牙冠高度坚固
B. 酸更容易侵入
C. 抗酸性更低
D. 釉柱更加紧密
E. 釉柱间基质钙化更加彻底

正确答案：B。酸更容易侵入

解析：形态学观察氟牙症牙面显示，发育不全使釉面横纹中断，在发育缺陷区牙面上可见清楚的釉柱末端。镜下可见釉质矿化不良，尤其是在釉柱之间及有机物较多的薄弱处。表层钙化良好，其深在的表层下区存在弥漫性的矿化不良。病变牙具有抗龋性，这是由于虽然病变使酸更易侵入，但釉柱较正常时有更强的抗酸溶解性。掌握“氟牙症、先天性梅毒牙与牙本质形成缺陷”知识点。